"起于目外眦…下行耳后"的经脉是
A. 足阳明胃经
B. 足少阳胆经
C. 足太阳膀胱经
D. 手少阳三焦经
E. 手太阳小肠经

正确答案：B。足少阳胆经

解析：足少阳胆经起于目锐眦，起于目外眦，上行额角部，下行至耳后，沿颈项部至肩上，下入缺盆（B对）；足阳明胃经（A错）起于鼻，入上齿，环口挟唇，至额颅；足太阳膀胱经（C错）起于目内眦，至耳上角，入络脑；手少阳三焦经（D错）一支脉，从耳后分出，进入耳中，再浅出到耳前，经上关、面颊到目外眦；手太阳小肠经（E错）一分支从缺盆分出，沿着颈部，上达面颊，至目外眦，入耳中。